碘量法测定维生素C的含量，应选
A. 淀粉指示剂
B. 喹哪啶红-亚甲蓝混合指示剂
C. 二苯胺指示剂
D. 邻二氮菲指示剂
E. 酚酞指示剂

正确答案：A。淀粉指示剂

解析：本题考查碘量法。维生素C含有烯二醇基，具有还原性，能够被碘溶液氧化，可以直接用标准碘溶液滴定测定含量，用淀粉作为指示剂（A对）。喹哪啶红-亚甲蓝混合指示剂（B错）是非水溶液滴定法测定维生素B₁时所用。二苯胺磺酸钠是氧化还原滴定法所用（C错）。邻二氮菲（D错）是铈量法所用指示剂。酚酞（E错）是酸碱滴定所用指示剂。